下述疾病中，哪项可由衣原体引起的
A. 急性呼吸道感染
B. 非淋菌性泌尿生殖道感染
C. 沙眼
D. 性病淋巴肉芽肿
E. 以上都是

正确答案：E。以上都是

解析：主要的病原性衣原体可以引起的疾病有：沙眼衣原体-沙眼/非淋球菌性尿道炎/性病淋巴肉芽肿；肺炎嗜衣原体-急性呼吸道感染；鹦鹉热嗜衣原体-鹦鹉热。掌握“衣原体”知识点。